患者腰膝酸软乏力，失眠多梦，心悸健忘。治疗宜选用
A. 麦门冬
B. 百合
C. 龟甲
D. 续断
E. 巴戟天

正确答案：C。龟甲

解析：腰膝酸软乏力，失眠多梦，心悸健忘为肾虚，阴血不足所致，应当使用滋阴潜阳，益肾强骨，养血补心的龟甲治疗（C对）。麦门冬（A错）的功效是养阴生津，润肺清心。虽然可以治疗心阴虚所致的失眠多梦，心悸健忘，不能治疗肾阴虚所致的腰膝酸软乏力。百合（B错）的功效是养阴润肺，清心安神。续断（D错）的功效是补肝肾，强筋骨，续折断，止崩漏。巴戟天（E错）的功效是补肾阳，强筋骨，祛风湿。